甲氨蝶呤不具有哪个性质
A. 结晶性粉末
B. 几乎不溶于乙醇
C. 溶于稀盐酸，易溶于稀碱溶液
D. 呈左旋
E. 在强酸中不稳定，可水解

正确答案：D。呈左旋